女，46岁。两眼不能完全睁开，全身无力，前上纵隔内发现肿块。最可能的是
A. 心包囊肿
B. 支气管囊肿
C. 胸腺瘤
D. 神经源性肿瘤
E. 淋巴瘤

正确答案：C。胸腺瘤

解析：中年女性，两眼不能完全睁开，全身无力（提示重症肌无力），前上纵膈内发现肿块（提示前上纵膈肿瘤），综上考虑诊断为胸腺瘤。心包囊肿（A错）常位于中纵膈。神经源性肿瘤（D错）、支气管囊肿（B错）和淋巴瘤（E错）常位于后纵隔。